婴幼儿咳嗽发烧，首选的X线检查方法是
A. 摄胸片正位
B. 摄胸片侧位
C. 摄胸片正侧位
D. 胸部透视
E. 支气管造影

正确答案：C。摄胸片正侧位

解析：婴幼儿咳嗽发烧，为上呼吸道感染，观察肺部情况，首选的X线检查方法是摄胸片正侧位，避免漏诊（C对）。正位胸片能看出心脏血管的大小、形态、位置以及轮廓，可以观察心脏与相邻器官的关系以及肺内血管的变化（A错）。斜位胸片可观察左右心房、左右心室有无增大、有无脉动脉段突出的情况；而侧位片则能观察心胸的前后直径以及胸郭畸形，有无肿瘤等（B错）。胸部透视可做全面动态的直接观察，如心脏搏动、横隔活动、胃肠蠕动、关节活动等（D错）。支气管造影是胸部疾病的重要检查方法之一，对支气管疾病有肯定的诊断价值（E错）。